猪苓汤的组成是
A. 苍术、陈皮、厚朴、甘草
B. 茵陈、栀子、大黄
C. 猪苓、茯苓、泽泻、阿胶、滑石
D. 猪苓、茯苓、泽泻、桂枝、白术
E. 附子、生姜、白术、茯苓、白芍

正确答案：C。猪苓、茯苓、泽泻、阿胶、滑石

解析：猪苓汤用猪茯苓，泽泻滑石阿胶并，小便不利兼烦渴，利水养阴热亦平（C对）。猪苓汤的功用为利水渗湿，养阴清热，主治水热互结伤阴证。